在盐酸普鲁卡因注射液处方中，盐酸（0.1mol／L）的作用是
A. 溶剂
B. pH调节剂
C. 渗透压调节剂
D. 抗氧剂
E. 抑菌剂

正确答案：B。pH调节剂

解析：本题考查注射剂常用的附加剂。盐酸普鲁卡因注射液是由溶剂、pH调节剂、渗透压调节剂、抗氧剂和抑菌剂等共同配制而成。盐酸普鲁卡因注射液处方分析：盐酸普鲁卡因-主药；氯化钠-渗透压调节剂（C错）；盐酸-pH调节剂（B对）；亚硫酸钠-抗氧剂（D错）；苯酚-抑菌剂（E错）；注射用水-溶剂（A错）。